来源于茄科，表面红色或暗红色的药材是
A. 五味子
B. 小茴香
C. 女贞子
D. 枸杞子
E. 栀子

正确答案：D。枸杞子

解析：本题考查的是枸杞子的来源及性状鉴别。来源于茄科，表面红色或暗红色的药材是枸杞子（D对）。枸杞子：【来源】为茄科植物宁夏枸杞的干燥成熟果实。【性状鉴别】药材呈类纺锤形或椭圆形，表面红色或暗红色。顶端有小突起状的花柱痕，基部有白色的果梗痕。果皮柔韧，皱缩；果肉肉质，柔润。种子20～50粒，类肾形，扁而翘，表面浅黄色或棕黄色。气微，味甜。五味子（A错）：【来源】为木兰科植物五味子的干燥成熟果实，习称“北五味子”。【性状鉴别】药材呈不规则的球形或扁球形。表面红色、紫红色或暗红色，皱缩，显油润；有的表面呈黑红色或出现“白霜”。果肉柔软，种子1～2粒，肾形，表面棕黄色，有光泽，种皮薄而脆。果肉气微，味酸；种子破碎后，有香气，味辛、微苦。小茴香（B错）：【来源】为伞形科植物茴香的干燥成熟果实。【性状鉴别】药材为双悬果，呈圆柱形，有的稍弯曲。表面黄绿色或淡黄色，两端略尖，顶端残留有黄棕色突起的柱基，基部有时有细小的果梗。分果呈长椭圆形，背面有纵棱5条，接合面平坦而较宽。横切面略呈五边形，背面的四边约等长。有特异香气，味微甜、辛。女贞子（C错）：【来源】为木犀科植物女贞的干燥成熟果实。【性状鉴别】药材呈卵形、椭圆形或肾形。表面黑紫色或灰黑色，皱缩不平。基部有果梗痕或具宿萼及短梗。体轻。外果皮薄，中果皮较松软，易剥离，内果皮木质，黄棕色，具纵棱，破开后种子通常为1粒，肾形，紫黑色，油性。气微，味甘、微苦涩。栀子（E错）：【来源】为茜草科植物栀子的干燥成熟果实。【性状鉴别】药材呈长卵圆形或椭圆形。表面红黄色或棕红色，具6条翅状纵棱，棱间常有1条明显的纵脉纹，并有分枝。顶端残存萼片，基部稍尖，有残留果梗。果皮薄而脆，略有光泽；内表面色较浅，有光泽，具2～3条隆起的假隔膜。种子多数，扁卵圆形，集结成团，深红色或红黄色，表面密具细小疣状突起。气微，味微酸而苦。